男，40岁。体重60kg，右上肢肩关节以下、右下肢膝关节以下烧伤，深度为浅Ⅱ度至深Ⅱ度，右足部烧伤深度为Ⅲ度。该患者的烧伤总面积为
A. 0.2
B. 0.38
C. 0.37
D. 0.19
E. 0.18

正确答案：D。0.19

解析：根据中国新九分法（P138表13-1），该患者的烧伤总面积=右上肢肩关节以下（即一侧上肢）9%+右下肢膝关节以下（即一侧小腿+足）10%=19%（D对）。右足部3.5%已经算在右下肢膝关节以下内，不做重复计算。